在2017年1月国务院批准公布的《中国防治慢性病中长期规划（2017-2025年）》中，力争30～70岁人群因心脑血管疾病、癌症、慢性呼吸系统疾病和糖尿病导致的过早死亡率较2015年降低
A. 0.05
B. 0.1
C. 0.15
D. 0.2
E. 0.25

正确答案：B。0.1